患者男，70岁。胸闷胸痛反复发作，心悸少寐，气短乏力，五心烦热，汗多口干，眩晕耳鸣，两颧潮红，舌红少苔，脉细数无力。心电图示：Ⅱ、Ⅲ、aVF导联ST段下移，T波倒置，心肌酶正常。其诊断是
A. 冠状动脉粥样硬化性心脏病心绞痛，痰瘀痹阻证
B. 急性心肌梗死，气阴两虚证
C. 高血压性心脏病，气阴两虚证
D. 冠状动脉粥样硬化性心脏病心绞痛，气阴两虚证
E. 冠状动脉粥样硬化性心脏病心绞痛，寒痰痹阻证

正确答案：D。冠状动脉粥样硬化性心脏病心绞痛，气阴两虚证

解析：患者胸闷胸痛反复发作（典型特点为发作性的心前区压榨性疼痛，主要位于胸骨后，可放射至心前区和左上肢内侧，常发生于劳力负荷增加时，持续数分钟），心电图示Ⅱ、Ⅲ、aVF导联ST段下移，T波倒置（心脏下壁缺血性改变），心肌酶正常（急性心肌梗死示心肌酶异常）。心气虚故见心悸少寐，气短乏力；阴虚内热故见五心烦热，汗多口干，眩晕耳鸣；虚火上炎故见两颧潮红，舌红少苔，脉细数无力（D对）。痰瘀痹阻证：气短痰多，肢体沉重，形体肥胖，纳呆恶心，疼痛入夜加重，伴有胸闷，舌质紫暗，或有瘀斑（A错）。急性心肌梗死心肌酶异常（B错）。高血压性心脏病主要表现为呼吸困难、咳嗽、咯痰、恶心、呕吐、心脏跳动的节律和频率不正常等左心衰竭、右心衰竭、全心衰竭表现（C错）。寒痰痹阻证：感寒痛甚，形寒，甚则四肢不温，冷汗自出，心悸短气（E错）。